感染性休克手术治疗时机
A. 即刻手术
B. 短期抗休克治疗后
C. 抗休克治疗无效时
D. 感染灶局限化以后
E. 感染灶即将破溃前

正确答案：B。短期抗休克治疗后

解析：感染性休克的治疗原则是在休克未纠正以前，应着重治疗休克，同时治疗感染，如需手术治疗，应在短期抗休克治疗后进行（B对）。立即手术（A错）一方面患者不能耐受，另一方面可能扩大感染灶，使病情加重；手术也不应等到抗休克治疗无效时（C错）、感染灶局限化以后（D错）或感染灶即将破溃前（E错）进行，因为原发感染灶的存在是发生休克的主要原因，尽早处理才能纠正休克和巩固疗效。